可参考胸痹辨证论的西药疾病是
A. 高血压病
B. 支气管炎
C. 冠心病
D. 支气管扩张病
E. 病毒性肺炎

正确答案：C。冠心病

解析：本题考查的是胸痹。可参考胸痹辨证论的西药疾病是冠心病（C对）。胸痹是指以胸部闷痛，甚则胸痛彻背，短气、喘息不得卧为主症的疾病，轻者仅感胸闷如窒，呼吸欠畅，重者则有胸痛，严重者心痛彻背，背痛彻心。西医学的冠心病（心绞痛或心肌梗死）、其他原因引起的心绞痛（如主动脉瓣狭窄、梗阻性肥厚型心肌病）、心包炎以及肺源性心脏病等以上述表现为主者，可参考此内容辨证论治。高血压病（A错）可参考眩晕辨证论治。眩晕是以头晕、眼花为主症的疾病。轻者闭目即止，重者如坐车船，旋转不定，不能站立，或伴恶心、呕吐、汗出、面色苍白等症，甚则突然晕倒。西医学的耳性眩晕（梅尼埃病、耳石症、晕动病）、脑性眩晕（椎-基底动脉供血不足、脑动脉粥样硬化）、颈源性眩晕（椎动脉型颈椎病）以及其他原因（血压异常、神经症、眼部疾患及外伤等）所致眩晕，均可参考此处辨证论治。支气管炎（B错）可参考喘证辨证论治。喘即气喘、喘息。喘证是以呼吸困难，甚至张口抬肩、鼻翼扇动、不能平卧为特征的疾病。西医学的肺炎、支气管炎、肺气肿、肺源性心脏病、心源性哮喘以及癔病等发生呼吸困难时，可参考此内容辨证论治。支气管扩张病（D错）可参考咳嗽辨证论治。咳嗽是指肺失宣降，肺气上逆作声，或伴咳吐痰液，为肺系疾病的主要表现之一。西医学中急慢性支气管炎、部分支气管扩张症、慢性咽炎、咳嗽变异性哮喘等以咳嗽为主要表现时，可参考此内容辨证论治。病毒性肺炎（E错）可参考治疗的疾病，2022年考试指南未明确说明。